风湿活动的正确判断指标是
A. 血沉慢
B. 血小板减少
C. 粘蛋白降低
D. C-反应蛋白增多
E. 血浆白蛋白增高

正确答案：D。C-反应蛋白增多

解析：C-反应蛋白增多（D对）、血沉增快（A错）、血小板计数正常（第二版8年制儿科学P182，第八版儿科学未明确表示）（B错）、α2球蛋白和黏蛋白增高（C错）。血沉增快时血浆白蛋白减少（E错）。